历史上医学模式的演变经历了几个阶段
A. 三
B. 四
C. 五
D. 六
E. 七

正确答案：C。五

解析：1.神灵主义医学模式
2.自然哲学医学模式
3.机械论医学模式
4.生物医学模式
5.生物 心理 社会医学模式